常规传染病报告属于
A. 主动监测
B. 被动监测
C. 第二级预防
D. 现况调查方法
E. 预防机构日常工作

正确答案：B。被动监测